刺激性气体对机体的作用特点是
A. 对眼睛和呼吸道黏膜的刺激作用
B. 对上呼吸道的刺激作用
C. 对皮肤的损伤作用
D. 刺激呼吸道出现咳嗽、胸闷等
E. 对肺脏产生刺激作用，引起肺水肿

正确答案：A。对眼睛和呼吸道黏膜的刺激作用